胸腺（thymus）是
A. B细胞经历阳性选择和阴性选择的场所
B. T细胞经历阳性选择和阴性选择的场所
C. 树突细胞经历阳性选择和阴性选择的场所
D. 巨噬细胞经历阳性选择和阴性选择的场所
E. 浆细胞经历阳性选择和阴性选择的场所

正确答案：B。T细胞经历阳性选择和阴性选择的场所

解析：胸腺（thymus）是T细胞经历阳性选择和阴性选择的场所。掌握“中枢和外周免疫器官”知识点。